颈部肿块，可随吞咽移动的是
A. 瘿瘤
B. 瘰疬
C. 瘤
D. 疹
E. 颈痈

正确答案：A。瘿瘤

解析：瘿瘤是指颈前结喉处有肿块，或单侧或双侧，质韧有弹性，表面光滑，边界清楚，无压痛，可随吞咽上下移动者。多因肝郁气滞痰凝，或与地方水土有关（A对）。瘰疬（B错）是指颈侧颈下有肿块，累累如串珠者。多由肺肾阴虚，虚火炼液为痰，或外感风火时毒夹痰所致。瘤（C错）是指瘀血、痰滞、浊气停留于人体组织之中，所形成的赘生物，多数不痒不痛，推之可移动，生长缓慢。疹（D错）为皮肤病的原发性皮损，局限性皮肤颜色的变化，不隆起也不凹陷。颈痈（E错）相当于西医的急性甲状腺炎、亚急性甲状腺炎，急性发病，喉结一侧或两侧肿胀木硬，灼热疼痛。